某医院血液科卖血赚钱，被人举报，其面临的处罚是
A. 处分
B. 没收违法所得，10万元以下罚款
C. 警告
D. 责令改正
E. 吊销医疗机构执业许可证

正确答案：B。没收违法所得，10万元以下罚款

解析：有下列行为之一的，由县级以上地方人民政府卫生行政部门予以取缔，没收违法所得，可以并处十万元以下的罚款（B对），构成犯罪的，依法追究刑事责任：（一）非法采集血液的；（二）血站、医疗机构出售无偿献血的血液的；（三）非法组织他人出卖血液的。